玉屏风口服液的功能有
A. 益气
B. 养阴
C. 固表
D. 补血
E. 止汗

正确答案：A、C、E。益气；固表；止汗